上焦热盛可见的汗是
A. 头汗
B. 半身汗
C. 手足心汗
D. 阴汗
E. 心胸汗

正确答案：A。头汗

解析：头汗又称但头汗出。指汗出仅见于头部，或头颈部汗出量多的症状。若兼见心胸烦闷，口渴面赤，多因上焦热盛，迫津外泄（A对）；若兼见身重倦怠，胃脘痞满，多因中焦湿热蕴结，湿郁热蒸，迫津上越；若兼见四肢厥冷，气喘脉微，多因元气将脱，阴阳离决，虚阳上越，津随阳泄。半身汗出指患者仅一侧身体汗出的症状，或左侧，或右侧，或见于上半身，或见于下半身。但汗出常见于健侧，无汗的半身常是病变的部位，多见于疫病、中风及截瘫患者。多因风痰、痰赍、风湿等阻滞经络，营卫不能周流，气血失和所致（B错）。手足心微汗出，多为生理现象。手足心汗出量多，则为病理性汗出。若兼见五心烦热，咽干口燥者，多因阴虚内热，迫津外泄；若兼见腹胀便秘，日哺潮热者，多因阳明燥热内结；若兼见口干欲饮，牙龈肿痛，肢体困重，便溏呕恶者，多因脾胃湿热内盛所致（C错）。阴汗，指外生殖器及周围部位经常汗多，且汗味多臊臭的病证（D错）。心胸汗出指心胸部易出汗或汗出过多的症状，多见于虚证。若兼见心悸、失眠、腹胀、便溏者，多为心脾两虚；若兼见心悸心烦、失眠、腰膝酸软者，多为心肾不交（E错）。